根据《中国药典》（一部）的规定，应采用薄层色谱法扫描测定其甜菜碱含量的药材是
A. 枳壳
B. 枸杞子
C. 马钱子
D. 山茱萸
E. 山楂

正确答案：B。枸杞子

解析：本题考查的是枸杞子的含量测定。根据《中国药典》（一部）的规定，应采用薄层色谱法扫描测定其甜菜碱含量的药材是枸杞子（B对）。枸杞子【含量测定】按《中国药典》采用薄层色谱法测定，本品含甜菜碱不得少于0.30%。枳壳（A错）【含量测定】按《中国药典》采用高效液相色谱法测定，本品含柚皮苷不得少于4.0%，含新橙皮苷不得少于3.0%。马钱子（C错）【含量测定】按《中国药典》采用高效液相色谱法测定，本品含士的宁应为1.20%～2.20%，马钱子碱不得少于0.80%。山茱萸（D错）【含量测定】按《中国药典》采用高效液相色谱法测定，本品含马钱苷和莫诺苷的总量不得少于1.2%。山楂（E错）【含量测定】按《中国药典》采用酸碱滴定法测定，本品含有机酸以枸橼酸计，不得少于5.0%。